睾丸动脉是
A. 腰动脉的分支
B. 肾动脉的分支
C. 腹主动脉的分支
D. 腹腔动脉的分支出
E. 髂总动脉的分支

正确答案：C。腹主动脉的分支

解析：腹主动脉的分支（C对）有睾丸动脉等，睾丸动脉为腹主动脉的成对的脏支。